确诊原发性免疫缺陷最重要的指标是
A. 白细胞计数和分类
B. 各类lg的检测
C. T、B细胞及吞噬细胞的功能检测
D. 检测相关基因的缺陷
E. 补体成分的检测

正确答案：D。检测相关基因的缺陷